女，45岁，既往月经正常，近1年来经期延长10～15天，量多，此次停经50天，后有阴道出血20天，血红蛋白80g/L，盆腔检查（一），基础体温单相。为排除宫体癌应该进行下列何项辅助诊断
A. CA125测定
B. 腹腔镜检查并作活检
C. 分段诊刮并送病理
D. 超声检查
E. 子宫输卵管造影

正确答案：C。分段诊刮并送病理

解析：中年女性，既往月经正常，近1年来经期延长，量多，此次停经50天，后有阴道出血20天，血红蛋白80g/L（正常值为大于110g/L，提示贫血），盆腔检查（-），基础体温单相（提示无排卵），根据患者的临床症状、体征及实验室检查，考虑最可能的诊断为无排卵性异常子宫出血，为排除宫体癌应该进行分段诊刮并送病理（C对），该检查适用于异常出血可疑子宫内膜癌者。腹腔镜检查并作活检（B错）用于其他检查提示存在宫腔或盆腔异常的患者，可明确病变位置和程度。CA125测定（A错）常用于卵巢癌的诊断。超声检查（D错）可查出子宫占位性病变，但对于肿瘤早期的诊断及肿瘤的性质没有优势。子宫输卵管造影（E错）主要用于了解输卵管是否通畅及宫腔是否黏连。